女性，35岁。上颌右侧第二磨牙（牙合）面纵向隐裂且累及牙髓，临床牙冠较短，咬合紧，根管治疗已完成。该病例的最适修复体设计是
A. 邻（牙合）瓷嵌体
B. 邻（牙合）合金嵌体
C. 全瓷冠
D. 铸造金属全冠
E. 金属烤瓷全冠

正确答案：D。铸造金属全冠

解析：本题考查修复体设计。女性，35岁。上颌右侧第二磨牙（后牙）（牙合）面纵向隐裂且累及牙髓，临床牙冠较短，咬合紧（牙体抗力不足），根管治疗已完成。该病例的最适修复体设计是铸造金属全冠（D对）。铸造金属全冠具有材料强度大、制作精密、固位力强、牙体磨切相对较少等优点。该病例患牙为有隐裂的无髓牙，剩余牙体组织无法提供足够的抗力，不适合嵌体修复（AB错）。全瓷冠（C错）和金属烤瓷全冠（E错）需要较大的（牙合）面修复间隙，而患牙临床牙冠短，咬合紧，无法获得较大的修复间隙，且患牙位置靠后，对美观要求不高。因此，最适合的修复方式是铸造金属全冠。